检查是否存在纤溶亢进的检查是
A. 肾上腺素试验
B. 凝血活酶生成及纠正试验
C. D－二聚体测定
D. 毛细血管脆性试验
E. 血小板聚集试验

正确答案：C。D－二聚体测定

解析：反映纤溶亢进的检查有①鱼精蛋白副凝（3P）试验、FDP、D-二聚体测定（C对）；②纤溶酶原测定；③t-PA、纤溶酶原激活物抑制物（PAI）及纤溶酶-抗纤溶酶复合物（PIC）测定等。肾上腺素试验（A错）可用于交感神经功能亢进、副交感神经功能亢进的鉴别；凝血活酶生成及纠正试验（B错）可用于各型血友病的诊断和鉴别诊断；毛细血管脆性试验（D错）可用于检测遗传性出血性毛细血管扩张症等疾病；血小板聚集试验（E错）主要反映血小板的聚集功能。